不属于非典型肺炎糖皮质激素的使用指征是
A. 严重中毒症状
B. 经对症治疗3天以上最高体温仍超过39℃
C. X线胸片显示多发或大片阴影
D. 达到急性肺损伤或ARDS诊断标准
E. 全身关节肌肉酸痛

正确答案：E。全身关节肌肉酸痛

解析：糖皮质激素的使用具有以下指征之一者可考虑应用：①有严重的中毒症状（A对），持续高热不退，经对症治疗5日以上最高体温仍超过39℃（B对）；②X线胸片显示多发或大片阴影，进展迅速，48小时之内病灶面积增大>50%在正位胸片上占双肺总面积的1/4以上（C对）；③达到急性肺损伤或出现ARDS（D对）（E错，为本题正确答案）。